糖尿病合并高血压的患者，血压控制目标值应小于
A. 130/80mmHg
B. 150/90mmHg
C. 140/80mmHg
D. 130/90mmHg
E. 140/90mmHg

正确答案：A。130/80mmHg

解析：糖尿病合并高血压时，属于心血管疾病高危人群。因此应该积极降压治疗，为达到目标水平，通常在改善生活方式的基础上需要两种以上降压药联合治疗。ACEI或ARB能有效减轻和延缓糖尿病肾病的进展，血压控制目标值应小于130/80mmHg（A对BCDE错）。